控制和消除生产性毒物常采取的措施是
A. 工艺改革，以无毒代有毒，低毒代高毒
B. 生产过程机械化、自动化、密闭化
C. 厂房建筑和生产过程的合理安排
D. 加强通风排毒
E. 以上各项都是

正确答案：E。以上各项都是